关于血管紧张素Ⅱ对肾小球入球及出球小动脉的收缩作用，正确的是
A. 对入球小动脉的收缩作用大于出球小动脉
B. 对入球小动脉的收缩作用小于出球小动脉
C. 对入球小动脉的收缩作用等于出球小动脉
D. 对入球小动脉无收缩作用
E. 对出球小动脉无收缩作用

正确答案：B。对入球小动脉的收缩作用小于出球小动脉

解析：血管紧张素Ⅱ（AngⅡ）对入球小动脉和出球小动脉都具有收缩作用，但由于出球小动脉对AngⅡ敏感性更高，所以其对入球小动脉的收缩作用小于出球小动脉（B对ACDE错）。